男，56，右侧颈部淋巴结肿大3月，发热1月。T38.8℃，双侧腹股沟淋巴结肿大，颈部淋巴结活检提示弥漫大B细胞淋巴瘤。考分期
A. II期B
B. III期B
C. III期A
D. II期A
E. IV期A

正确答案：B。III期B

解析：患者男，56，右侧颈部淋巴结肿大3月，发热1月。T38.8℃，双侧腹股沟淋巴结肿大，颈部淋巴结活检提示弥漫大B细胞淋巴瘤，结合患者的表现，提示为III期B（B对C错）。